关于上颌尖牙唇面特点叙述中错误的是
A. 唇轴嵴的位置在尖牙唇面中部由牙尖顶伸至牙颈1/3的突起
B. 在唇轴嵴的两侧各有一条发育沟
C. 唇面外形高点在中1/3与颈1/3交界处的唇轴嵴上
D. 唇面外形高点在上1/3与中1/3交界处的唇轴嵴上
E. 初萌时，近远中斜缘在牙尖相交形成的角度约为90°

正确答案：D。唇面外形高点在上1/3与中1/3交界处的唇轴嵴上

解析：本题考查上下颌前牙的外形及临床应用解剖。上颌尖牙初萌时，近、远中斜缘在牙尖顶端相交呈的角度约为90°（E对）；唇面中部由牙尖顶伸至颈1/3的突起（A对）形成唇轴嵴。唇轴嵴两侧各有一条发育沟（B对），唇面的外形高点在中1/3与颈1/3交界处的唇轴嵴上（C对），唇面外形高点不是在上1/3与中1/3交界处的唇轴嵴上（D错，为本题正确答案），说法不严谨准确。